与患者的沟通技巧包括
A. 开放式提问
B. 认真聆听
C. 尽量使用专业术语
D. 注意掌握时间
E. 正确使用微笑，手势等肢体语言

正确答案：A、B、D、E。开放式提问；认真聆听；注意掌握时间；正确使用微笑，手势等肢体语言

解析：本题考查沟通技巧。与患者沟通的技巧包括：药师与患者之间宜采用开放式提问（A对）；药师应认真聆听患者主诉（B对）；药师与患者沟通时应注意掌握时间，与患者的谈话时间不宜过长（D对）；药师与患者交谈时，要注意观察对方的表情变化，同时正确使用微笑、手势等肢体语言（E对）；药师与患者沟通时应尽量避免使用专业术语（C错）。